属于慢性毒性试验的主要目的的是
A. 探讨LOAEL和NOAEL
B. 闸明毒物的作用机制
C. 观察中毒症状
D. 探讨剂量-反应关系
E. 以上都是

正确答案：B。闸明毒物的作用机制